高血压病人，心功能评价指标增高
A. 每搏输出量
B. 射血分数
C. 心指数
D. 射血量
E. 心脏做功量

正确答案：E。心脏做功量

解析：左心室每搏功（P92）（J）=搏出量（L）×13.6（kg/L）×9.807×（平均动脉压-左心房平均压）（mmHg）×0.001，高血压病人，平均动脉压升高，所以左心室每搏功增加，心脏做功量（E对）增加。高血压病人，动脉血压升高，可使心输出量暂时减少，但是通过自身调节可使心输出量很快得到恢复，使一侧心室一次的射血量（D错）即每搏输出量（A错）保持不变。心指数=心输出量/体表面积（m2），心输出量不变，体表面积不变，所以心指数（C错）不变。射血分数=每搏输出量/心室舒张末期容积，由于动脉血压升高，代偿作用使心腔变大，所以射血分数（B错）降低。